牡丹皮除清热凉血外，又能
A. 解毒透疹
B. 活血散瘀
C. 润肠通便
D. 利尿通淋
E. 燥湿止痒

正确答案：B。活血散瘀

解析：本题考查的是牡丹皮的功效。牡丹皮除清热凉血外，又能活血散瘀（B对）。牡丹皮：【功效】清热凉血，活血散瘀，退虚热。紫草：【功效】凉血活血，解毒透疹（A错）。决明子：【功效】清肝明目，润肠通便（C错）。白薇：【功效】退虚热，凉血清热，利尿通淋（D错），解毒疗疮。白矾：【功效】外用解毒杀虫，燥湿止痒（E错）；内服止血止泻，清热消痰。